关于脊柱上端与颅骨的连结，正确的是
A. 包括寰枕关节和寰枢关节
B. 不包括寰枢关节
C. 不包括寰枕关节
D. 覆膜与前纵韧带相续
E. 摇头动作主要发生在寰枕关节

正确答案：A。包括寰枕关节和寰枢关节

解析：脊柱上端与颅骨连结包括：两侧枕髁与寰椎侧块的上关节凹构成的寰枕关节和寰枢关节（A对）。